翻瓣术后可探测牙周袋的时间
A. 4周以后
B. 6周以后
C. 8周以后
D. 3个月以后
E. 半年以后

正确答案：B。6周以后

解析：牙周病行牙龈翻瓣术后牙齿动度可稍有增加，但4周后可恢复至术前水平。术后6周内勿探测牙周袋，以免破坏新附着过程。掌握“慢性牙周炎的治疗原则、程序及方法”知识点。